关于口腔境界叙述中错误的是
A. 前界为上下唇
B. 后界为舌根
C. 两界为颊
D. 上界为腭
E. 下界为舌下区

正确答案：B。后界为舌根

解析：口腔的境界：前界为上下唇，后界为咽门，两侧为颊，上界为腭，下以舌下区为界。由上下牙列、牙龈和牙槽骨弓将口腔分为两部分，牙列的唇颊侧部分称为口腔前庭。牙列的舌侧部分称为固有口腔。掌握“口腔境界及唇、颊的局部解剖”知识点。